美国一女性患者，患有严重的脑综合征、压疮、心脏病、糖尿病等，对环境没有感觉，只有原始的脑功能，有自主呼吸，没有认识、行为能力，且无改善的希望，住院不久即插入鼻饲管以维持生命。她的监护人要求取走鼻饲管，被主管医师拒绝，监护人向法院起诉要求强迫取走，法院同意并下令取走：但受理上诉的法院否定了这个决定，认为中止喂饲就是杀人。3年后，女患者死亡，她的鼻饲管仍保留着。主管医师拒绝患者监护人的请求，其理由是：医疗行为必须体现
A. 医乃仁术
B. 生命神圣
C. 不伤害原则
D. 尊重患者自主原则
E. 以上都是

正确答案：E。以上都是